男，63岁。上腹部不适、消瘦半年。体重下降8kg，粪便隐血试验阳性。查体：剑突下深压痛，无反跳痛。应首先考虑的诊断是
A. 慢性胃炎
B. 胃溃疡
C. 十二指肠溃疡
D. 胃癌
E. 慢性胆囊炎

正确答案：D。胃癌

解析：老年男性患者，上腹部不适（消化不良症状），消瘦、体重下降（恶病质表现）。实验室检查：粪便隐血试验阳性，提示消化道出血。查体：剑突下深压痛（胃癌进展期剑突下有深压痛）。综合患者病史、查体和实验室检查，考虑诊断为胃癌（D对）。慢性胃炎（P355）（A错）患者可出现中上腹不适、饱胀、钝痛、烧灼痛等，无明显消瘦和消化道出血等症状。胃溃疡（P359）（B错）多见于中老年，十二指肠溃疡（C错）多见于青壮年，二者均呈周期性、节律性上腹痛，腹痛可被抑酸或抗酸药缓解，无明显消瘦。慢性胆囊炎（E错）多见于40岁左右肥胖女性，主要表现为与进食油腻食物相关的腹痛，无明显消瘦。